瞳孔大小的变化
A. 随光线强弱而变化
B. 随眼压高低而变化
C. 随晶状体凸度变化而变化
D. 取决于房水循环的通畅与否

正确答案：A。随光线强弱而变化

解析：瞳孔大小的变化随光线强弱而变化（A对）或视物远近而变化。